制作准备的全口义齿可恢复适当的垂直距离，其作用不包括
A. 避免下颌前伸
B. 使面部比例和谐
C. 使肌张力正常
D. 发挥最大咀嚼效能
E. 有益于颞下颌关节健康

正确答案：A。避免下颌前伸

解析：本题考查恢复适当的垂直距离的作用。制作准备的全口义齿可恢复适当的垂直距离，其作用不包括避免下颌前伸（A错，为本题的正确答案）。在排牙的时候应注意达到合适的覆（牙合）、覆盖关系，准备记录水平颌位关系，有避免下颌前伸的作用，因而恢复适当垂直距离的作用不包括避免下颌前伸。垂直距离为自然牙列呈正中（牙合）时，鼻底至颏底的距离，也就是面部下1/3的距离，合适的垂直距离能保持面部下1/3的高度，使面部比例和谐（B对），与面部的丰满度、美观有关，也可使髁状突在颞颌关节凹内处于适中而又舒适的位置，有益于颞下颌关节健康（E对）。若垂直距离恢复得过大，则肌肉张力增加，容易出现肌肉疲劳；垂直距离恢复得过小，咀嚼肌的紧张度降低，咀嚼时用力较大，咀嚼效能较低，因而适当的垂直距离有利于使肌张力正常（C对），发挥最大的咀嚼效能（D对）。